治疗心悸心血不足证，应首选
A. 天王补心丹
B. 安神定志丸
C. 桂枝甘草龙骨牡蛎汤
D. 归脾汤
E. 朱砂安神丸

正确答案：D。归脾汤

解析：心悸心血不足证的病机是心血亏耗，心失所养，心神不宁；需要补血养心，益气安神；益气补血，健脾养心的归脾汤最为合适（D对）。心悸阴虚火旺证治宜滋阴降火，养心安神，方选天王补心丹合朱砂安神丸（A错）。心悸心虚胆怯证治宜镇惊定志，养心安神，方选安神定志丸（B错）。心悸心阳不振证治宜温补心阳，安神定悸，方选桂枝甘草龙骨牡蛎汤合参附汤（C错）。心悸阴虚火旺证治宜滋阴降火，养心安神，方选天王补心丹合朱砂安神丸（E错）。